《中国药典》规定大青叶来源于
A. 蔷薇科
B. 马鞭草科
C. 蓼科
D. 十字花科
E. 毛茛科

正确答案：D。十字花科

解析：本题考查的是大青叶的来源。《中国药典》规定大青叶来源于十字花科（D对）。大青叶：【来源】为十字花科植物菘蓝的干燥叶。来源于蔷薇科（A错）的中药有地榆、枇杷叶、木瓜、山楂、苦杏仁、桃仁、乌梅、金樱子等。来源于蓼科（C错）的中药有大黄、虎杖、何首乌、蓼大青叶等。来源于毛茛科（E错）的中药有威灵仙、川乌、附子、白芍、赤芍、升麻等。来源于马鞭草科（B错）的中药，2022年考试指南未明确说明。